与消化性溃疡关系最密切的是
A. 心、脾
B. 肝、胆
C. 肝、脾
D. 肺、脾
E. 心、肾

正确答案：C。肝、脾

解析：本病多因虚而致病，起病缓慢，反复发作。初起在气，久病入血。病变部位主要在胃，与肝、脾关系密切（C对），脾胃虚弱是其发病基础。肝脏主一身气机，肝失疏泄，横逆犯胃，胃失和降，可致胃痛。脾为水谷运化之脏，脾胃虚弱，温养失职，导致不荣则痛。故当肝脾发生病变时多能影响到胃而引起疾病（ABDE错）。